男性患者59岁，上牙列缺失，48健康，近中舌侧倾斜，牙槽嵴丰满，上颌散在骨尖，颌间距离正常。戴用义齿一周后需复诊调（牙合）的原因是
A. 加强义齿固位
B. 基托下沉
C. 义齿咬合平衡已建立
D. 义齿基托边缘位置可确定
E. 病人已经可以用新义齿嚼食物

正确答案：B。基托下沉

解析：本题考查戴用义齿一周后需复诊调（牙合）的原因。因为黏膜具有可让性，当基托戴入口内后，基托受力，黏膜避让导致基托下沉（B对）。此时，需要复诊调（牙合）。义齿戴入口内时，应保证其具有良好的固位力，因此不须调（牙合）加强义齿固位（A错）。义齿咬合平衡已建立（C错）、义齿基托边缘位置可确定（D错）及病人已经可以用新义齿嚼食物（E错）时，说明义齿使用情况良好，并不需调（牙合）。